以一级动力学消除的某药物，其半衰期t1/2=8h，若按照恒定剂量每隔一个半衰期给药，达到稳态血药浓度所需的时间为
A. 10小时
B. 20小时
C. 30小时
D. 40小时
E. 50小时

正确答案：D。40小时

解析：以一级动力学消除的某药物，其半衰期t1/2=8h，若按照恒定剂量每隔一个半衰期给药，达到稳态血药浓度所需的时间为40小时（D对ABCE错）。